保持牙齿位置正常不移位的因素包括
A. 充足的牙周支持组织
B. （牙合）力与唇颊舌肌力
C. 牙列的完整
D. 正常牙齿形态和邻接
E. 以上都是

正确答案：E。以上都是

解析：本题考查保持牙齿位置正常不移位的因素。牙齿在牙弓中位置是否移位是由多种因素影响的，包括：充足的牙周支持组织（A对）：牙周膜的主纤维束一端埋入牙骨质内，另一端埋入牙槽骨，从而将牙悬吊固定在牙槽窝内；牙槽骨包围和支持牙根，使牙稳定牢固地固定在牙槽窝。（牙合）力和面部各组肌肉间的动力平衡（B对）使牙受力稳定，行使功能时保持位置正常不移位。牙列的完整性（C对）和正常牙齿形态和邻接关系（D对）使得牙之间相互支撑，不会倾斜伸长。（ABCD均对，故E为本题的正确答案）。